龋病的药物治疗不适用于
A. 静止龋
B. 猖獗龋
C. 牙本质浅龋
D. 未成洞的浅龋
E. 乳牙龋

正确答案：B。猖獗龋

解析：本题考查药物治疗的适应证。猖獗龋是急性龋的一种，病变进展较快，应及时充填治疗（B错，为本题的正确答案）。药物治疗的适应症有：静止龋（A对），乳牙牙本质浅龋及浅龋（C对），尚未形成龋洞的恒牙釉质早期龋（D对），1年内将被恒牙替换的乳前牙邻面浅龋及乳磨牙面广泛型浅龋（E对）。